关于本体感觉传导通路的描述，正确的是
A. 意识性本体感觉通路经脊髓小脑束
B. 非意识性本体感觉通路经薄束
C. 脊髓后索内纤维属意识性本体感觉通路的第一级纤维
D. 外侧索内有传导意识性本体感觉的纤维通过
E. 以上都不是

正确答案：C。脊髓后索内纤维属意识性本体感觉通路的第一级纤维

解析：本体感觉传导通路即躯干和四肢意识性本体感觉和精细触觉传导通路。该通路由3级神经元组成：第1级神经元为脊神经节内假单极神经元，即脊髓后索内纤维（C对）。躯干和四肢意识性本体感觉通路经内侧丘系（A错），内有传导意识性本体感觉的纤维通过（D错）。躯干和四肢非意识性本体感觉通路经过脊髓小脑束（B错）。